47颊（牙合）面窝洞，按Black窝洞分类法应是
A. Ⅱ类洞
B. Ⅰ类洞
C. Ⅲ类洞
D. Ⅳ类洞

正确答案：B。Ⅰ类洞

解析：本题考查Black分类法。47颊（牙合）面窝洞，按Black窝洞分类法应是Ⅰ类洞（B对）。Ⅰ类洞：所有牙面发育点隙裂沟的龋损所备成的窝洞，包括磨牙和前磨牙的（牙合）面洞、下颌磨牙的颊（牙合）面洞等。Ⅱ类洞：后牙邻面的龋损所备的窝洞（A错）。Ⅲ类洞：前牙邻面未累及切角的龋损所备成的窝洞（C错）。Ⅳ类洞：前牙邻面累及切角的龋损所备成的窝洞（D错）。Ⅴ类洞：所有牙齿颊（唇）舌面颈1/3处的龋损所备成的窝洞。